哪类疫苗由政府免费向公民提供
A. 第一类
B. 第二类
C. 第三类
D. 第四类
E. 全部

正确答案：A。第一类